能够使黄体即使萎缩，子宫内膜完整脱落，干扰受精卵着床而起到避孕效果的激素类药物是
A. 睾丸酮
B. 雄性激素
C. 雌激素
D. 孕激素
E. 环磷酰胺

正确答案：D。孕激素

解析：大剂量孕激素能够使子宫内膜脱落，黄体萎缩，从而干扰受精卵着床，而起到避孕的效果。掌握“激素避孕”知识点。